女，32岁。慢性膀胱刺激症状逐渐加重3个月。KUB+IVU见右肾有钙化影，肾影增大，无功能。应考虑的疾病是
A. 右肾结核
B. 右肾肿瘤
C. 右肾结石
D. 肾盂肾炎
E. 右肾积水

正确答案：A。右肾结核

解析：青年女性患者，慢性膀胱刺激症状逐渐加重（提示可能有泌尿系感染），KUB+IVU见右肾有钙化影，肾影增大，无功能（提示可能有肾结核），结合患者临床表现和相关检查，应考虑的疾病是右肾结核（A对）。右肾肿瘤（P563）（B错）主要表现为间歇无痛性肉眼血尿、腰痛和腹部肿块。右肾结石（C错）（P558）主要表现为有痛性血尿。肾盂肾炎（D错）（P535）主要表现为寒战高热、腰痛和膀胱刺激症状。肾积水（E错）常无症状，且一般无钙化灶。